下列表现属于肺癌副癌综合征的是
A. 一侧眼睑下垂、瞳孔缩小
B. 声音嘶哑
C. 胸壁静脉曲张
D. 吞咽困难
E. 杵状指

正确答案：E。杵状指

解析：肺癌的副癌综合征包括杵状指（趾）肥大性骨关节病（E对）、分泌促肾上腺皮质激素样物、重症肌无力、稀释性低钠血症、男性乳房发育、高钙血症、类癌综合征等。眼睑下垂、瞳孔缩小（A错）为肺尖部肺癌压迫颈交感神经导致的Horner综合症表现。声音嘶哑（B错）为喉返神经受压迫时的表现。胸壁静脉曲张（C错）为肿瘤直接侵犯纵隔，或转移的肿大淋巴结压迫上腔静脉，或腔静脉内癌栓阻塞所导致的静脉回流受阻。吞咽困难（D错）为肿瘤侵犯或压迫食管所导致的。